新生儿，诊断为单侧完全性唇裂合并单侧完全性腭裂，同时伴有鼻部畸形。最先实施的手术治疗是唇裂整复术，腭裂的正畸治疗应开始于新生儿无牙期，何时进行语音治疗
A. 2岁
B. 3岁
C. 4岁
D. 患儿能与医师配合时
E. 患儿上小学后

正确答案：D。患儿能与医师配合时

解析：本题考查腭裂语音治疗的适应证。腭裂患儿在手术已获得良好的腭咽闭合功能后，才可接受语音治疗，并且要求患儿能与语音治疗医师良好配合（D对），不合作者不宜接受语音训练。腭裂患儿语音治疗的关键在于患儿能否与医师配合进行语音训练和增强腭咽闭合功能训练，年龄并不是衡量患儿能否进行语音训练的标准，2岁（A错）、3岁（B错）、4岁（C错）以及上小学后（E错）的患儿在手术已获得良好的腭咽闭合功能后，若能与医师配合，则可进行语音治疗，若不能配合，则不能进行语音治疗，患儿什么时候能与医师配合，则什么时候开始语音治疗。